肝功能不全患者因肝功能减退，药物代谢受到严重影响，在肝脏的作用时间延长，故此类患者应在医师指导下慎重选药，用药时执业药师可给予的合理用药指导有
A. 服药初始宜从小剂量开始
B. 不能使用有毒中药
C. 服药期间定期检查肝功能
D. 选择肝毒性小的药物
E. 注意观察用药后的反应

正确答案：A、C、D、E。服药初始宜从小剂量开始；服药期间定期检查肝功能；选择肝毒性小的药物；注意观察用药后的反应

解析：本题考查的是肝功能不全患者的用药。肝功能不全患者因肝功能减退，药物代谢受到严重影响，在肝脏的作用时间延长，故此类患者应在医师指导下慎重选药，用药时执业药师可给予的合理用药指导有服药初始宜从小剂量开始（A对）、服药期间定期检查肝功能（C对）、选择肝毒性小的药物（D对）与注意观察用药后的反应（E对）。肝功能不全患者的用药：肝功能不全对体内药物的药动学影响重大，一般情况下，其对药物代谢的影响与疾病的严重程度呈正比。执业药师在指导此类患者的用药时要注意在明确诊断的前提下，选择低风险药物，避免或减少使用对肝脏毒性大的药物，注意药物之间的相互作用，在联合用药时，要避免肝毒性药物的合用。要选择肝毒性小，从肾脏排泄的药物。初始宜从小剂量开始，必要时要进行血药浓度监测，做到个体化给药。要指导患者定期检查肝功能，及时调整治疗方案。